预防医学的特点不包括
A. 着重于疾病预防
B. 研究方法上注重微观和宏观结合
C. 研究对象包括个体和群体
D. 以环境、人群为研究重点
E. 着重于个体治疗

正确答案：E。着重于个体治疗

解析：预防医学研究对象包括个体及确定的群体（C对），不仅仅只针对个体，着重于个体治疗的主要应用于临床救治患者中（E错，为本题正确答案）。预防医学目的在于促进健康和预防疾病（A对），重点在环境与人群健康的关系（D对），在研究方法上注重微观与宏观相结合（B对）。